创伤性溃疡的治疗错误的是
A. 保留残根
B. 使用含漱剂
C. 防止感染和止痛
D. 修改或拆除不合适的修复体
E. 磨改锐利的牙尖或切嵴

正确答案：A。保留残根

解析：首先应去除局部刺激因素，如拔除残根，修改或拆除不合适的修复体，磨改锐利的牙尖或切嵴。磨钝乳切牙嵴，溃疡未愈合时可用汤匙喂养。更换橡皮奶嘴。掌握“创伤性溃疡”知识点。